引起小儿佝偻病的主要原因是
A. 缺钙
B. 缺乏维生素D
C. 甲状旁腺功能不全
D. 食物中热能和蛋白质不足
E. 食物中钙磷比例不当

正确答案：B。缺乏维生素D

解析：维生素D缺乏性佝偻病是由于儿童体内维生素D不足使钙、磷代谢紊乱，产生的一种以骨骼病变为特征的全身慢性营养性疾病，主要见于2岁以下婴幼儿。掌握“维生素D缺乏性佝偻病”知识点。